肾的主要生理功能是
A. 化生阳气
B. 主司呼吸
C. 化生气血
D. 调节阴阳
E. 藏精、纳气、主骨生髓

正确答案：E。藏精、纳气、主骨生髓

解析：本题考查的是肾的生理功能。肾的主要生理功能是藏精、纳气、主骨生髓（E对）。肾的生理功能主要有三方面：一是藏精，主生长、发育与生殖；二是主水；三是主纳气。主司呼吸（B错）为肺的生理功能。肺的生理功能，包括肺主气、司呼吸，主宣发肃降，通调水道，朝百脉而主治节。化生气血（C错）为脾的生理功能。脾的生理功能主要有两方面：一是主运化，二是主统血。其中脾运化水谷精微，是指脾对饮食物的消化和水谷精微的吸收、转输、布散的作用。饮食物由胃受纳腐熟，必须依赖于脾的运化功能，才能将水谷转化为精微物质，转输到心肺，布散于全身，从而使各个脏腑、组织、器官得到充足的营养，并通过心肺的作用化生气血，故“脾为后天之本，气血生化之源”。调节阴阳（D错）即调整阴阳，属于疾病的基本治则。疾病的发生，其根本即是阴阳的相对平衡遭到破坏，出现偏盛偏衰的结果。因此，调整阴阳，使之恢复平衡，促进阴平阳秘，也是临床治疗的根本法则之一。化生阳气（A错），2022年考试指南未明确说明。